（）中毒有可能引起迟发性脑病
A. CO
B. NO
C. HCN
D. 氯气

正确答案：A。CO

解析：本题考查迟发性脑病的致病因素。一氧化碳中毒（A对BCD错）后会导致大脑后脱髓鞘和细胞变性，会引起迟发性脑病。可以用纳洛酮进行治疗。纳洛酮是特异性阿片受体拮抗剂、神经元保护剂，对一氧化碳中毒病人可以起到有效的治疗作用。